声音持续时间小于0.5秒，间隔时间大于1秒，声压变化大于40dB者称为
A. 连续性噪声
B. 脉冲性噪声
C. 稳态噪声
D. 非稳态噪声
E. 高频噪声

正确答案：B。脉冲性噪声